以下关于颧牙槽嵴的叙述，正确的是
A. 与颧骨相接，向下至第一磨牙处形成颧牙槽嵴
B. 上颌体后面颞下面参与颞下窝和翼腭窝前壁的构成，有颧牙槽嵴
C. 是上牙槽后神经阻滞麻醉的重要标志
D. 颧突支柱沿颧牙槽嵴上行达颧骨后分为两支
E. 以上都正确

正确答案：E。以上都正确

解析：颧突：与颧骨相接，向下至第一磨牙处形成颧牙槽嵴。颧突支柱主要承受第一磨牙区的咀嚼压力，起于上颌第一磨牙区的牙槽突，沿颧牙槽嵴上行达颧骨后分为两支，上颌体后面（颞下面）参与颞下窝和翼腭窝前壁的构成，有颧牙槽嵴。掌握“上颌骨解剖特点”知识点。